下列各项中，属于四逆汤主治病证临床表现的是
A. 神衰欲寐
B. 脐腹疼痛
C. 心下满痛
D. 泄利下重
E. 烦躁欲死

正确答案：A。神衰欲寐

解析：四逆汤为回阳救逆的基础方，临床应用以四肢厥逆，神衰欲寐，面色苍白，脉微细为辨证要点，主治心肾阳衰寒厥证（A对）。